川乌的使用注意有
A. 孕妇忌服
B. 反天花粉
C. 畏犀角
D. 不宜过量服
E. 不宜久服

正确答案：A、B、C、D、E。孕妇忌服；反天花粉；畏犀角；不宜过量服；不宜久服